下列引起头痛的病因中，属于颅外病变的是
A. 三叉神经痛
B. 脑膜炎
C. 尿毒症
D. 脑震荡
E. 脑肿瘤

正确答案：A。三叉神经痛

解析：引起头痛的主要病因有：①颅脑病变：感染，如脑膜炎（B错）、脑炎等；血管病变，如脑出血、脑血栓形成等；占位性病变，如脑肿瘤（E错）、颅内转移瘤等；颅脑外伤，如脑震荡（D错）、脑挫伤等；其他，如腰椎穿刺后及腰椎麻醉后头痛等。②颅外病变：颅骨疾病，如颅底凹陷症等；颈部疾病，如颈椎病及其他颈部疾病；神经痛，如三叉神经（A对）、舌咽神经及枕神经痛等；其他，如眼、耳、鼻和齿等疾病所致的头痛。③全身性疾病：急性感染，如流感、伤寒等发热性疾病；心血管疾病，如高血压、心力衰竭等；中毒，如铅、酒精、一氧化碳等中毒；其他，如尿毒症（C错）、低血糖、贫血等。④精神心理因素：如抑郁、焦虑等精神障碍。